关于流脑的流行病学特点，正确的是
A. 患者是重要传染源
B. 传播途径主要经飞沫传播
C. 细菌毒力强，故间接传播亦重要
D. 本病发生有严格季节性（冬春季）
E. 感染后仅产生对本群细菌的免疫，无交叉免疫

正确答案：B。传播途径主要经飞沫传播